化学毒物代谢酶最主要分布在
A. 微粒体或细胞核
B. 微粒体或细胞膜
C. 微粒体或胞浆
D. 细胞膜和胞浆

正确答案：C。微粒体或胞浆

解析：本题考查化学毒物代谢酶的最主要分布部位。化学毒物代谢酶最主要分布在微粒体或胞浆（C对ABD错）。